根尖组织病理切片可见根尖区组织血管扩张充血，浆液渗出，组织水肿，少量中性粒细胞游离出血管，此阶段称为
A. 慢性根尖周炎
B. 根尖周肉芽肿
C. 急性浆液性根尖周炎
D. 急性化脓性根尖周炎
E. 根尖周肉芽肿

正确答案：C。急性浆液性根尖周炎

解析：本题考查急慢性根尖周炎。根尖组织病理切片可见根尖区组织血管扩张充血，浆液渗出，组织水肿，少量中性粒细胞游离出血管，此阶段称为急性浆液性根尖周炎（C对）。急性根尖周炎可直接由急性牙髓炎向根尖周扩展而来，早期可见根尖周区组织血管扩张充血，浆液渗出，组织水肿，少量中性粒细胞游出血管，此阶段称急性浆液性根尖周炎。